引起肺血栓栓塞症的血栓最常来源于
A. 盆腔静脉
B. 下肢深静脉
C. 肺静脉
D. 锁骨下静脉
E. 颈内静脉

正确答案：B。下肢深静脉

解析：引起PTE的栓子可以来源于下腔静脉径路、上腔静脉径路或右心腔，其中大部分来源于下肢深静脉（B对），特别是从腘静脉上端到髂静脉段的下肢近端深静脉（约占50%-90%）。